豨莶草的功效是
A. 祛风湿，通经络，利小便
B. 祛风湿，通经络，降血压
C. 祛风湿，通经络，安神志
D. 祛风湿，通经络，消痰水
E. 祛风湿，通经络，化瘀血

正确答案：B。祛风湿，通经络，降血压

解析：本题考查的是豨莶草的功效。豨莶草的功效是祛风湿，通经络，降血压（B对）。豨莶草：【功效】祛风湿，通经络，清热解毒，降血压。青风藤：【功效】祛风湿，通经络，利小便（A错）。威灵仙：【功效】祛风湿，通经络，消痰水（D错），治骨鲠。功效为祛风湿，通经络，安神志（C错）或祛风湿，通经络，化瘀血（E错）的中药，2022年考试指南未明确说明。